治疗肿疡期肿而有结块，应选用的药物是
A. 生肌白玉膏
B. 金黄膏
C. 九一丹
D. 无极膏
E. 皮质类固醇激素软膏

正确答案：B。金黄膏

解析：金黄膏长于除湿化痰，对肿而有结块，尤其是急性炎症控制后形成的慢性迁延性炎症更为适宜（B对）。肌白玉膏功能润肤生肌收敛，适用于溃疡腐肉已净、疮口不敛者，以及乳头皲裂、肛裂等病（A错）。溃后脓肿切开或刺烙排脓后，可用八二丹或九一丹提脓祛腐（C错）。无极膏具有消炎镇痛的作用，主要适应于虫咬皮炎（D错）。皮质类固醇激素软膏具有明显的抗炎、抗过敏和免疫抑制作用（E错）。